某女，20岁，2天前受风后出现左侧面部麻木，额纹消失，眼裂变大，鼻唇沟变浅，口角下垂歪向左侧，舌淡，苔薄白针刺面部穴位应采用
A. 直刺深刺
B. 多穴重刺
C. 轻刺浅刺
D. 提插泻法
E. 电针强刺激

正确答案：C。轻刺浅刺

解析：患者受风后出现左侧面部麻木，为感受外邪后中风，面部肌肉痉挛所致。治宜针刺面部腧穴，疏通经络。临床实践表明，治疗不同病证需针刺不同深度，《素问·刺要论》指出：“病有浮沉，刺有浅深，各至其理，无过其道。”面部肌肉少而五官多，刺宜轻刺浅刺，减小刺激量，减少刺入深度（C对）。